灾害后发生消化性溃疡属于
A. 灾害创伤性疾病
B. 灾害感染性疾病
C. 生理应激性疾病
D. 心理应激性疾病
E. 心理、生理双重应激性疾病

正确答案：E。心理、生理双重应激性疾病